功能清热止痛的药物是
A. 麝香
B. 冰片
C. 两者均是
D. 两者均不是

正确答案：B。冰片

解析：本题考查的是冰片的功效。功能清热止痛的药物是冰片（B对）。冰片：【功效】开窍醒神，清热止痛。麝香（A错）：【功效】开窍醒神，活血通经，消肿止痛。